以疾病特性命名的外科疾病是
A. 背疽
B. 肺痈
C. 破伤风
D. 白驳风
E. 流注

正确答案：E。流注

解析：本题考查疾病的命名原则。外科疾病命名是有一定规律可循的。一般是依据其发病部位、穴位、脏腑、病因、形态、颜色、特征、范围、病程、传染性等分别加以命名的。流注是发于肌肉深部的急性化脓性疾病，是以其特征命名（E对）。背疽，是以部位命名的（A错）。肺痈，是以脏腑命名的（B错）。破伤风，是以病因命名的（C错）。白驳风，是以颜色命名的（D错）。